男，30岁。肛门周围胀痛伴发热3天。排便时疼痛加重。查体：肛门周围皮肤发红、压痛明显。最可能的诊断是
A. 直肠后间隙脓肿
B. 肛管括约肌间隙脓肿
C. 骨盆直肠间隙脓肿
D. 肛周皮下脓肿
E. 直肠粘膜下脓肿

正确答案：D。肛周皮下脓肿

解析：患者肛周胀痛、皮肤发红、压痛，局部症状突出，全身感染症状轻微，最可能的是位置表浅的肛周皮下脓肿（D对）。直肠后间隙脓肿（A错）是腹腔内的脓肿，全身中毒症状比较轻，但不会出现肛门周围皮肤红肿疼痛。肛管括约肌间隙脓肿（B错）全身中毒症状及局部症状都比较明显。骨盆直肠间隙脓肿（C错）位置较深，主要以全身中毒症状为主，局部症状轻微。直肠粘膜下脓肿（E错）位置较深，局部症状不明显，主要表现为会阴部坠涨。